初产妇，26岁。妊娠40周，规律宫缩3小时，胎膜破裂后突然出现烦躁不安，寒战，呼吸困难，发绀，数分钟后即死亡。首先应考虑的诊断是
A. 羊水栓塞
B. 先兆子宫破裂
C. 子痫
D. 胎盘早剥
E. 前置胎盘

正确答案：A。羊水栓塞

解析：患者妊娠40周，规律宫缩3小时，胎膜破裂后突然出现烦躁不安，寒战，呼吸困难，发绀，数分钟后即死亡，说明患者出现了呼吸衰竭和休克，是羊水栓塞的临床表现之一，胎膜破裂是发生羊水栓塞的条件之一（A对）。先兆子宫破裂主要表现为：1.产妇可见明显下腹痛，烦躁不安，脉搏、呼吸加快，排尿困难或可见血尿，也可伴有阴道流血。2.产程延长，子宫体部强直性收缩，下段伸展变薄，有压痛，按压疼痛，拒绝按压及触摸，阵缩时子宫下段隆起，在子宫体部与下段间形成环状的病理性缩复环，使子宫呈葫芦形，此病理性缩复环随产程延长而渐渐升高。3.胎动次数增多，胎心率不稳，变快、变慢或快慢不均（B错）。子痫是子痫前期基础上发生不能用其它原因解释的抽搐。是妊娠期高血压疾病的五种状况之一（C错）根据病情严重程度将胎盘早剥分为3度∶①Ⅰ度：胎盘剥离面积小、多见于分娩期，可见轻度腹痛或无腹痛，贫血不明显…产后检查胎盘母体面有陈旧凝血块及压迹…（D错）。前置胎盘是妊娠28周后，胎盘附着于子宫下段，甚至胎盘下缘达到或覆盖宫颈内口，其位置低于胎先露部，称为前置胎盘（E错）。